石韦的功效有
A. 泻热通便
B. 清心除烦
C. 利水通淋
D. 清肺止咳
E. 凉血止血

正确答案：C、D、E。利水通淋；清肺止咳；凉血止血

解析：本题考查的是石韦的功效。石韦的功效有利水通淋（C对）、清肺止咳（D对）与凉血止血（E对）。石韦：【功效】利尿通淋，凉血止血，清肺止咳。番泻叶：【功效】泻热通便（A错），消积健胃。灯心草：【功效】利尿通淋，清心除烦（B错）。